男，36岁，平素体健。淋雨后发热，咳嗽2天，右上腹痛伴气急恶心1天。除考虑急腹症外，重点鉴别的疾病是
A. 自发性气胸
B. 肺梗死
C. 肺炎链球菌肺炎
D. 肺结核
E. 膈神经麻痹

正确答案：C。肺炎链球菌肺炎

解析：患者为中青年男性（为肺炎链球菌肺炎的好发年龄），有淋雨后发热病史（肺炎链球菌肺炎发病前常有受凉、淋雨史），咳嗽、右上腹痛、气急、恶心等症状，根据其临床表现和体征，考虑诊断为肺炎链球菌肺炎（C对），所以除考虑急腹症外，重点鉴别的疾病是肺炎链球菌肺炎。自发性气胸（P25）（A错）临床表现为突然加重的呼吸困难，并有明显发绀，患侧肺部叩诊为鼓音，听诊呼吸音减弱或消失。肺梗死（P99）（B错）出现呼吸困难、胸痛及咯血“三联征”，不符合上述病例表现。肺结核（P65）（D错）常出现咳嗽、咳痰或痰中带血，多为长期午后潮热、部分患者有倦怠乏力、盗汗，病变范围较小时，可以没有任何症状。膈神经麻痹（E错）可使膈肌麻痹，出现呼吸暂停，甚至引起严重的后果。